引起维生素D缺乏性佝偻病的主要病因是
A. 生长发育过快
B. 肝肾功能不全
C. 纯母乳喂养
D. 单纯牛乳喂养
E. 体内维生素D不足使钙、磷代谢紊乱

正确答案：E。体内维生素D不足使钙、磷代谢紊乱

解析：维生素D缺乏性佝偻病是由于儿童体内维生素D不足使钙、磷代谢紊乱，产生的一种以骨骼病变为特征的全身慢性营养性疾病，主要见于2岁以下婴幼儿。掌握“维生素D缺乏性佝偻病”知识点。